李某，男，68岁。患肺心病多年，诊见：喘息气粗，烦躁，胸满，咳嗽，痰黄或白，黏稠难咯，或身热，微恶寒，有汗不多，溲黄便干，口渴，舌红，舌苔黄，边尖红，脉数。治疗应首选的方剂是
A. 苏子降气汤
B. 生脉散合血府逐瘀汤
C. 补肺汤
D. 越婢加半夏汤
E. 小青龙汤

正确答案：D。越婢加半夏汤

解析：本病患者为肺心病，痰浊内蕴化热，痰热壅肺，故痰黄、粘稠难咯；肺热内郁，清肃失司，肺气上逆，则喘咳气逆息粗，烦躁，胸满，溲黄便干；复感外邪，风热犯肺，故见发热微恶寒，有汗不多等表证。口渴，舌红，苔黄或黄腻，脉数或滑数均为痰热内郁之征，宜用越婢加半夏汤（D对）；苏子降气汤用于痰浊壅肺证，症状：咳嗽痰多，色白黏腻或呈泡沫样，短气喘息，稍劳即著，脘痞纳少，倦怠乏力，舌质偏淡，苔薄腻或浊腻，脉滑（A错）；生脉散合血府逐瘀汤用于气虚血瘀证，症状：喘咳无力，气短难续，痰吐不爽，心悸，胸闷，口干，面色晦暗，唇甲发绀，神疲乏力，舌淡黯，脉细涩无力（B错）；补肺汤用于肺肾气虚证，症状：呼吸浅短难续，声低气怯，甚则张口抬肩，倚息不能平卧，咳嗽，痰白清稀如沫，胸闷，心慌，汗出，形寒，舌淡或黯紫，脉沉细微无力，或有结代（C错）；小青龙汤用于外寒内饮证，症状：咳逆喘息不得卧，痰多稀薄，恶寒发热，背冷无汗，渴不多饮，或渴喜热饮，面色青晦，舌苔白滑，脉弦紧（E错）。